在定量构效关系方程中，使用到的结构参数有
A. ED₅₀
B. α
C. π
D. Es
E. LD₅₀

正确答案：B、C、D。α；π；Es